烧伤最常见的死亡原因是
A. 休克
B. ARDS
C. 肾功能衰竭
D. 感染
E. 心功能衰竭

正确答案：D。感染